铸造（牙合）支托长度为
A. 双尖牙近远中径的1/4
B. 双尖牙近远中径的1/2
C. 磨牙近远中径的1/2
D. 磨牙近远中径的1/3
E. 磨牙近远中径的1/4

正确答案：E。磨牙近远中径的1/4

解析：铸造（牙合）支托应薄而宽，呈匙形，颊舌宽度约为磨牙颊舌径的1/3或前磨牙的颊舌径的1/2。其长度约为磨牙近远中径的1/4或前磨牙近远中径的1/3，厚度为1～1.5mm。掌握“局部义齿固位体”知识点。